锌主要分布在
A. 骨
B. 骨髓
C. 牙齿
D. 肌肉组织
E. 甲状腺

正确答案：D。肌肉组织